关于肺结核描述错误的是
A. 严重危害人类健康
B. 以飞沫传播
C. 传染源主要是继发性肺结核的患者
D. 尚不可治愈
E. 结核分枝杆菌是结核病的病原菌

正确答案：D。尚不可治愈

解析：本题考查肺结核。肺结核至今仍然是严重危害人类健康（A对）的主要传染病。结核分枝杆菌是结核病的病原菌（E对），传染源主要是继发性肺结核的患者（C对），尤其是那些未被发现和未给予治疗管理或治疗不合理的涂片病原菌阳性患者，通过咳嗽、喷嚏等方式把含有结核分枝杆菌的微滴排到空气中而由飞沫传播（B对）。经过化学药物和其他的一系列手段，肺结核是可以治愈的（D错，为本题正确答案）。